破伤风梭菌的主要致病物质是
A. 外毒素
B. 菌毛
C. 鞭毛
D. 荚膜
E. 芽胞

正确答案：A。外毒素

解析：破伤风梭菌的主要致病物质是破伤风痉挛毒素，是破伤风梭菌产生的一种外毒素（A对）。破伤风梭菌有周鞭毛、无荚膜（D错），菌毛（B错）主要见于革兰阴性菌，破伤风梭菌革兰染色阳性。菌毛、鞭毛与霍乱弧菌的致病性有关（C错）（P125）。荚膜是肺炎链球菌的主要致病物质（P100）。芽胞（E错）是破伤风梭菌在土壤中的主要存在方式，不是破伤风杆菌的致病物质，呈正圆形，直径大于菌体，位于菌体顶端，使细菌呈鼓锤状，为该菌的典型特征。